为增强金合金瓷结合，可采用的方法除了
A. 喷砂
B. 预氧化
C. 超声清洗
D. 除气
E. 电解蚀刻

正确答案：E。电解蚀刻

解析：本题考查增强金瓷结合的方法。电解蚀刻不能增加金瓷结合（E错，为本题的正确答案）金-瓷结合机制主要由三种结合力组成：即化学结合力、机械结合力、范德华力。喷砂增大了金-瓷结合的机械结合力（A对），预氧化提供了金-瓷结合的化学结合力（B对），超声清洗增大了金-瓷结合界面的湿润性，去除金属表面的污染（C对），除气减少了基质内含有的气泡，增大了与瓷的结合（D对）。。